评价预防接种效果的免疫学指标是
A. 抗体阳转率、抗体平均滴度
B. 标化率、续发率
C. 引入率、抗体阳转率
D. 有效率，抗体平均滴度
E. 保护率、效果指数

正确答案：A。抗体阳转率、抗体平均滴度